釉质龋病变的主要部分是
A. 透明层
B. 暗层
C. 表层
D. 病损体部
E. 细菌侵入层

正确答案：D。病损体部

解析：本题考查牙釉质龋。病损体部（D对）是釉质龋病变的主要部分，从表层下一直延伸到近暗层。